镉可以通过食物链的富集作用而在某些食品中达到很高的浓度，下列哪种食品最高
A. 海产食品
B. 谷类
C. 洋葱
D. 豆类
E. 萝卜

正确答案：A。海产食品